小儿昏睡露睛多属
A. 肺经郁热
B. 肝胆火炽
C. 肾精不足
D. 心阴亏损
E. 脾胃虚衰

正确答案：E。脾胃虚衰

解析：昏睡露睛是指患者入睡后胞睑未闭合而睛珠外露，多因脾虚清阳不升，或津液大伤，胞睑失养，启闭失常所致，多见于脾胃虚衰（E对）或吐泻伤津的患者。肝胆火炽见于绿风内障、中毒（如杏仁、麻黄、曼陀罗中毒）及某些西药（如阿托品）所致的药物性瞳孔散大（B错）。瞳孔散大见于肾精耗竭的危重患者，是濒死前的征象之一（C错）。肺经郁热、心阴亏损所致的目态异常改变不是昏睡露睛（AD错）。